表示气温和气湿综合作用的结果为
A. 黑球温度
B. 湿球温度
C. 干球温度
D. 有效温度
E. 校正有效温度

正确答案：B。湿球温度

解析：本题考查本题考查小气候的综合评价指标。表示气温和气湿综合作用的结果为湿球温度（B对）。黑球温度（A错）表示气温、热辐射和气流综合作用的结果。干球温度（C错）是从暴露于空气中而又不受太阳直接照射的干球温度表上所读取的数值。有效温度（D错）是在不同温度、湿度和风速的综合作用下，人体产生的冷热感觉指标。校正有效温度（E错）是在有效温度基础上，综合考虑热辐射对机体的影响，将干球温度（气温）改用黑球温度，所得的有效温度。